修复时需采取功能性印模的牙列缺损类型是
A. Kennedy第一类和第二类
B. Kennedy第一类和第三类
C. Kennedy第二类和第三类
D. Kennedy第一类和缺隙短的第四类
E. Kennedy第三类和缺隙短的第四类

正确答案：A。Kennedy第一类和第二类

解析：本题考查可摘局部义齿的印模种类。修复时需采取功能性印模的牙列缺损类型是Kennedy第一类和第二类（A对）。Kennedy第一类为牙弓双侧游离端缺失，Kennedy第二类为牙弓一侧游离端缺失，远中均无天然牙存在，为牙和黏膜混合支持式义齿，应取功能性印模；Kennedy第三类为牙弓一侧牙缺失，缺隙两侧都有天然存在，可行固定桥修复或牙支持式的可摘局部义齿修复，取模时应取解剖式印模（BC错）；Kennedy第四类为牙弓前部牙连续缺失并跨过中线，短缺隙可行固定桥修复，取解剖式印模（DE错）。